龟鹿补肾丸具有补肾壮阳、益气血、壮筋骨的功能。处方组成：盐菟丝子51g、淫羊藿（蒸）43g、续断（盐蒸）43g、锁阳（蒸）51g、狗脊（盐蒸）64g、酸枣仁（炒）43g、制何首乌64g、炙甘草21g、陈皮（蒸）21g、鹿角胶（炒）9g、熟地黄64g、龟甲胶（炒）13g、金樱子（蒸）51g、炙黄芪43g、山药（炒）43g、覆盆子（蒸）85g。以上十六味，粉碎成细粉，过筛，混匀，每100g粉末加炼蜜40g，加适量水泛丸，干燥，制成水蜜丸；或加炼蜜100～110g制成大蜜丸，即得。龟鹿补肾丸可制备为水蜜丸和大蜜丸，关于水蜜丸和大蜜丸特点和质量要求的说法，错误的是
A. 龟鹿补肾丸若制备成大蜜丸，可以嚼碎后咽下，不检查溶散时限
B. 大蜜丸富含蜂蜜，具有作用缓和持久的特点
C. 龟鹿补肾丸若制成12g的大蜜丸，须进行装量检查
D. 除另有规定外，大蜜丸中所含水分不得过15.0%
E. 除另有规定外，水蜜丸中所含水分不得过12.0%

正确答案：C。龟鹿补肾丸若制成12g的大蜜丸，须进行装量检查

解析：本题考查丸剂的质量要求和特点。龟鹿补肾丸可制备为水蜜丸和大蜜丸，下列关于水蜜丸和大蜜丸特点和质量要求的说法，错误的是龟鹿补肾丸若制成12g的大蜜丸，须进行装量检查（C错，为本题正确答案）。丸剂的质量要求：（1）装量，以重量标示的多剂量包装丸剂，照《中国药典》规定的最低装量检查法检查，应符合规定。以丸数标示的多剂量包装丸剂不检查装量。（2）溶散时限，除另有规定外，小蜜丸、水蜜丸和水丸应在1小时内全部溶散；浓缩丸和糊丸应在2小时内全部溶散；滴丸应在30分钟内全部溶散，包衣滴丸应在1小时内全部溶散。蜡丸照崩解时限检查法片剂项下的肠溶衣片检查法检查，在盐酸溶液中（9→1000）检查2小时，不得有裂缝、崩解或软化现象，再在磷酸盐缓冲液（pH6.8）中检查，1小时内应全部崩解。除另有规定外，大蜜丸及研碎、嚼碎后或用开水、黄酒等分散后服用的丸剂不检查溶散时限（A对）。（3）除另有规定外，蜜丸和浓缩蜜丸中所含水分不得过15.0%（D对）；水蜜丸和浓缩水蜜丸不得过12.0%（E对）；水丸、糊丸、浓缩水丸不得过9.0%。蜡丸不检查水分。蜜丸的特点：①性质柔润，作用缓和持久（B对）。②有补益和矫味作用，由于蜂蜜含有大量的糖、有机酸及维生素等丰富的营养成分，具有滋补作用；味甜能矫味；同时蜂蜜具有镇咳、缓下、润燥、解毒的作用。